（115～117题共用题干）女，48岁，G2P2。月经周期紊乱伴潮热1年，阴道流血35天，伴头晕、乏力10天。妇科检查见宫颈轻度糜烂，无触血，子宫大小形态正常，双侧附件区未触及异常。超声检查示：子宫内膜厚0.8cm，无血流信号。该患者最有可能的诊断是
A. 功能失调性子宫出血
B. 宫颈上皮内瘤变
C. 子宫颈鳞癌
D. 子宫内膜炎
E. 异位妊娠

正确答案：A。功能失调性子宫出血

解析：患者48岁，正值绝经过渡期（无排卵性功血好发于绝经过渡期），月经周期紊乱伴潮热（内分泌紊乱表现），阴道流血35天伴头晕、乏力10天（由阴道大量出血所导致的贫血症状）。子宫及双附件未见异常（排除子宫器质性病变）。超声检查示：子宫内膜厚0.8cm，无血流信号。根据患者的临床表现和辅助检查，最可能的诊断为功能失调性子宫出血（A对）（P344）。宫颈上皮内瘤变（B错）（P303）无特殊症状，偶有阴道排液增多，可出现接触性出血。子宫颈鳞癌（C错）（P307~308）常表现为接触性出血，晚期会累及其他器官，宫颈多有赘生物或肥大、质硬。子宫内膜炎（D错）多表现为盆腔区域疼痛和白带增多，阴道分泌物可见大量白细胞。异位妊娠（E错）（P53）患者有停经史，腹痛为其主要临床症状，腹部检查有压痛、反跳痛，盆腔检查有宫颈举痛和摇摆痛，与患者症状不符。